不负责任心，延误急危患者的抢救和诊治造成严重后果情节严重的
A. 追究刑事责任
B. 吊销医师执业证书
C. 罚款
D. 承担赔偿责任
E. 警告或责令暂停执业活动6月～1年

正确答案：B。吊销医师执业证书

解析：《执业医师法》规定，医师在执业活动中，违反本法规定，由于不负责任延误急危患者抢救和诊治，造成严重后果的，由县级以上人民政府卫生行政部门给予警告或者责令暂停执业活动6月～1年（E错）；情节严重的，吊销医师执业证书（B对）；构成犯罪的，依法追究刑事责任（A错）。